后纵隔肿瘤最常见的是
A. 畸胎瘤
B. 神经源性肿瘤
C. 胸腺瘤
D. 淋巴源肿瘤
E. 胸内甲状腺

正确答案：B。神经源性肿瘤

解析：临床上以胸骨角与第四胸椎下缘的水平线为界，将纵隔分为上、下两部。下纵隔再以心包前后界分为前、中、后三部分。后纵隔肿瘤常见的有神经源性肿瘤、淋巴瘤，其中以神经源性肿瘤（B对D错）最常见。畸胎瘤（A错）多位于前纵隔。胸腺瘤（C错）、胸内甲状腺（E错）均多位于前上纵隔。